患者出现上述异常检测结果的最可能原因是
A. 急性间质性肾炎
B. 肾后性梗阻
C. 药物不良反应
D. 急性肾小管坏死
E. 血容量减低

正确答案：E。血容量减低

解析：患者高血压15年，规律服用氢氯噻嗪和卡托普利降压，近三天来腹泻，呈稀水样便，尿量300～400ml/d，实验室检查：血肌酐、血尿素氮增高，尿渗透压增加，考虑为服用利尿剂导致的严重腹泻，致使血容量减低（E对），而导致尿量减少（24小时尿量少于0.4 L即为少尿）、尿液渗透压增高、血肌酐增高、血尿素氮增高，而非氢氯噻嗪和卡托普利不良反应直接引起（C错）。急性间质性肾炎主要表现为寒战、高热、血白细胞增高、核左移等全身感染性症状，以及肾小管性蛋白尿、镜下血尿、白细胞尿等（A错）。肾后性梗阻表现为突然发生完全性无尿或间歇性无尿、有泌尿系统结石症状（B错）。急性肾小管坏死可有少尿或无尿、恶心、呕吐、腹泻、贫血、水电解质紊乱、昏迷、抽搐等表现（D错）。